既治疗急危重症，又治疗闪挫腰痛的腧穴是
A. 印堂
B. 上星
C. 素髎
D. 水沟
E. 百会

正确答案：D。水沟

解析：水沟属于督脉腧穴，位于人中沟的上1/3与中1/3交点处。水沟主治：①昏迷、晕厥、中风、中暑、休克、呼吸衰竭等急危重症，为急救要穴之一②癔症、癫狂痫、急慢惊风等神志病③鼻塞、鼻衄、面肿、口歪、齿痛、牙关紧闭等面鼻口部病证④闪挫腰痛（D对）。印堂主治：①痴呆、痫证、失眠、健忘等神志病证②头痛，③鼻衄，鼻渊④小儿惊风、产后血晕、子痫（A错）。上星主治：①鼻渊、鼻衄、头痛、目痛等头面部病②热病、疟疾③癫狂（B错）。素髎主治：①昏迷、惊厥、新生儿窒息、休克、呼吸衰竭等急危重症②鼻渊、鼻衄等鼻病（C错）。百会主治：①痴呆、中风、失语、瘛疭、失眠、健忘、癫狂痫证、癔症等神志病②头痛，眩晕，耳鸣③脱肛、阴挺、胃下垂、肾下垂等气失固摄而致的下陷性病证（E错）。